不是内耳的结构
A. 耳蜗
B. 前庭
C. 骨半规管
D. 蜗管
E. 前庭窗

正确答案：E。前庭窗

解析：内耳形状不规则，构造复杂，又称迷路，由骨迷路和膜迷路两部分组成。骨迷路分为耳蜗（A对）、前庭（B对）和骨半规管（C对）3 部分组成。膜迷路由椭圆囊和球囊、膜半规管和蜗管（D对）3 部分组成。前庭窗（E错，为本题正确答案）是岬的后上方一卵圆形小孔，岬是内侧壁中部的圆形隆起，内侧壁为鼓室的组成部分，鼓室属于中耳。